“圣人不治已病治未病”出自
A. 《论友谊》
B. 《论语》
C. 《黄帝内经》
D. 《论人的本性》
E. 《一颗失而复得的心》

正确答案：C。《黄帝内经》

解析：关于维护人类健康要注重预防、注意心理健康的思想源远流长。早在2000多年前的《黄帝内经》中就已强调“圣人不治已病治未病”。掌握“心理健康概述”知识点。